患者尿量为3000mL/24h，尿比重为1.035，应考虑的原因是
A. 大量饮水后
B. 肾功能不全
C. 糖尿病
D. 尿崩症
E. 精神性多尿

正确答案：C。糖尿病

解析：患者尿量>2500mL/24h称为多尿，病理性多尿常见于内分泌代谢障碍性疾病（糖尿病、尿崩症），有浓缩功能障碍的肾脏疾病（慢性肾炎、慢性肾盂肾炎、慢性间质性肾炎、急性肾衰竭多尿期）以及精神性多尿症。尿比密增高:见于急性肾小球肾炎、糖尿病、蛋白尿、失水、血容量不足等（C对）。大量饮水后尿量会出现短暂性增高，但尿比重无变化（A错）。肾功能不全可表现为少尿，或者非少尿型。同时根据患者导致肾功能不全病因不同，尿比重也可以出现升高或者降低的情况（B错）。尿崩症的尿比重减低，常小于1.003（D错）。精神性多尿尿量增加，但尿比重常表现为下降（E错）。